下列关于生长发育的说法，错误的是
A. 生长是指细胞繁殖、增大和细胞间质增加
B. 发育是指细胞、组织的分化及功能的不断完善
C. 生长属于质变，发育属于量变
D. 生长发育结束时个体形态、功能达成人水平
E. 生长和发育是一个动态过程，二者密不可分

正确答案：C。生长属于质变，发育属于量变